女性，40岁，右上腹阵发性绞痛伴恶心呕吐3小时来院急诊。体温37℃，右上腹轻压痛，Murphy征（-）。既往检查胆囊内有小结石。对该病人首先考虑胆囊结石合并
A. 急性胆囊炎
B. 急性胆管炎
C. 急性胆绞痛
D. 急性胰腺炎
E. 急性胃炎

正确答案：C。急性胆绞痛

解析：胆绞痛为胆管管壁痉挛引起的疼痛，表现为骤然右上腹或中上腹的阵发性绞痛，多发生于胆囊炎、胆结石、胆道蛔虫症急性发作期。患者胆囊小结石，突发右上腹绞痛，故应诊断为急性胆绞痛（C对）。急性胆囊炎（A错）常表现为胆绞痛和Murphy征阳性。急性胆管炎（B错）的典型表现即Charcot三联征，即腹痛、寒战高热、黄疸。急性胰腺炎（D错）常表现为上腹部或左上腹部持续性剧痛，非右上腹。急性胃炎（E错）常表现为上腹隐痛，并非绞痛。